某女，30岁。因服用大量地西泮导致昏迷而人院。诊断为：地西泮急性中毒。此时除洗胃及其他支持疗法外，应给予特异性的解毒药是
A. 阿托品
B. 解磷定
C. 氟马西尼
D. 尼可刹米
E. 贝美格

正确答案：C。氟马西尼

解析：地西泮为长效的苯二氮䓬类药物，临床可用于焦虑、失眠，服用剂量过大可引起共济失调，甚至可导致呼吸和循环抑制，严重者可致呼吸和心跳停止，可用苯二氮䓬受体拮抗剂氟马西尼（C对）进行抢救，氟马西尼能与苯二氮䓬特异位点结合，竞争性拮抗苯二氮䓬类药的中枢效应，有效的催醒患者和改善中毒所致的呼吸和循环抑制。阿托品（A错）为解救有机磷酸酯中毒的特异性、高效能解毒药物。解磷定（B错）临床用于中、重度有机磷酸酯类中毒的解救。尼可刹米（D错）临床用于中枢性呼吸以及循环衰竭、麻醉药及其他中枢抑制剂的中毒。贝美格（E错）临床多用于解除巴比妥以及其他镇定催眠药所致的呼吸抑制，亦可用于减少硫喷妥钠麻醉的深度，以加速其恢复。